薄层色谱法的固定相有
A. 硅胶H
B. 硅胶G
C. 氧化铝
D. 滤纸
E. 聚酰胺

正确答案：A、B、C、E。硅胶H；硅胶G；氧化铝；聚酰胺